在基因工程中，将目的基因与载体DNA连接的酶是
A. DNA聚合酶Ⅰ
B. DNA聚合酶Ⅱ
C. 限制性核酸内切酶
D. DNA连接酶
E. 反转录酶

正确答案：D。DNA连接酶

解析：在基因工程中，将目的基因与载体DNA连接的酶是DNA连接酶（D对），其可催化DNA中相邻的5＇-磷酸基和3＇-羟基末端之间形成磷酸二酯键，使DNA切口封合或使两个DNA分子或片段连接。DNA聚合酶Ⅰ（A错）的功能是合成双链cDNA分子或片段连接、缺口平移法制作高比活性探针、DNA序列分析、填补3＇-端。限制性核酸内切酶（C错）的功能是识别特异序列，切割DNA。反转录酶（E错）的功能是合成cDNA，替代DNA聚合酶Ⅰ进行填补、标记，DNA序列分析。DNA聚合酶Ⅱ（P285）（B错）的功能是DNA复制中的校对、DNA修复。